某医科大学医学专业研究生1999年7月毕业后分配到三级医院从事临床工作，同年12月擅自另行开设诊所独立行医。依据《中华人民共和国执业医师法》，其行为属于
A. 未取得医师资格非法行医
B. 执业医师行医
C. 执业助理医师行医
D. 个体行医
E. 未办理手续非法行医

正确答案：A。未取得医师资格非法行医

解析：1999年5月1日开始实行《中华人民共和国执业医师法》，根据规定具有高等学校医学专业本科以上学历（是指国务院教育行政部门认可的各类高等学校医学专业本科以上学历），在执业医师指导下，在医疗、预防、保健机构中试用期满1年，才可以参加执业医师考试。该医生1999年7月研究生毕业，分配到三级医院从事临床工作，同年12月擅自另行开设诊所独立行医，他从事医院临床工作不满一年，所以还未取得执业医师资格证，同年12月又擅自另行开设诊所独立行医，所以该医生属于未取得医师资格非法行医（A对）。